牙骨质龋的发生机制叙述错误的是
A. 牙骨质的发生始于菌斑下
B. 早期病变为表层下脱矿
C. 细菌产酸导致牙骨质脱矿
D. 脱矿后的牙骨质可以重新矿化
E. 牙骨质深层矿化程度高于表层

正确答案：E。牙骨质深层矿化程度高于表层

解析：本题考查牙骨质龋。牙骨质龋的发生机制叙述错误的是牙骨质深层矿化程度高于表层（E错，为本题正确答案）。牙骨质龋的发生始于菌斑下，早期病变为表层下脱矿。病变开始时，牙骨质表面菌斑下由于细菌产酸使牙骨质脱矿。而唾液、菌斑中的矿物离子可以在脱矿后的牙骨质表面沉积，同时氟容易被牙骨质摄取，也加强了表层的再矿化，造成表层矿化相对增高。此时的病变为潜行性牙骨质龋。